儿童苯丙酮尿症的初筛选用方法是
A. DNA分析
B. 血浆游离氨基酸分析
C. 尿三氯化铁试验
D. 尿蝶呤分析
E. Guthrie细菌生长抑制试验

正确答案：C。尿三氯化铁试验

解析：较大婴儿和儿童苯丙酮尿症的初筛选用方法是尿三氯化铁试验（C对）。新生儿初筛是Guthrie细菌生长抑制试验（E错）。DNA分析主要用于基因突变检测，进行基因诊断和产前诊断（A错）。尿蝶呤分析主要用于BH4缺乏症的鉴别诊断（D错）。血浆游离氨基酸分析用于初筛后的确诊（B错）。